苯丙酮尿症新生儿筛查釆用的是
A. 尿有机酸分析
B. 血氨基酸分析
C. 尿蝶呤分析
D. 尿三氯化铁试验
E. Guthri细菌生长抑制试验

正确答案：E。Guthri细菌生长抑制试验

解析：新生儿筛查PKU多用Guthrie细菌生长抑制试验，新生儿哺乳3天后针刺足跟采集外周血，滴于采集滤纸上，放在含有抑制剂的变异型枯草杆菌培养基上培养，患儿血液中的苯丙氨酸可以使被抑制的枯草杆菌重新生长，从而根据细菌带生长情况估计血液中苯丙氨酸含量，如超标则需要进一步检查（E对）。尿三氯化铁试，由于新生儿PKU苯丙氨酸代谢旁路未健全，患者尿液测定为阴性，一般用于较大儿童（D错）。尿有机酸分析（A错）和血氨基酸分析（B错）可为PKU提供生化诊断依据并鉴别其他的氨基酸、有机酸代谢病，但不能作为PKU的诊断依据。尿蝶呤分析用于鉴别PKU的分型，非诊断依据（C错）。